《中华人民共和国行政处罚法》规定，行政机关应当事先告知当事人有要求举行听证的权利才能作出行政处罚决定的是
A. 暂扣许可证或执照
B. 一千元以下罚款
C. 没收违法所得
D. 没收非法财物
E. 较大数额罚款

正确答案：E。较大数额罚款

解析：本题考查听证程序。《中华人民共和国行政处罚法》规定行政机关作出责令停产停业、吊销许可证或者执照、较大数额罚款（E对）等行政处罚决定之前，应当告知当事人有要求举行听证的权利；当事人要求听证的，行政机关应当组织听证。当事人不承担行政机关组织听证的费用。暂扣许可证或执照（A错）、没收违法所得（C错）、没收非法财物（D错）属于行政处罚，不适用于听证程序。对法人或者其他组织处1000元以下的罚款（B错）或者警告时，适用于简易程序。